男，28岁。个体户，有冶游史1周，2天前自觉尿痛、尿频，尿道口出脓，查体：尿道口有大量脓性分泌物，此时何种疾病可能性大
A. 梅毒
B. 生殖器疱疹
C. 疱疹
D. 淋病
E. 艾滋病

正确答案：D。淋病

解析：青年男性患者，有冶游史，自觉尿痛、尿频，尿道口出脓（提示有尿道感染），查体见尿道口有大量脓性分泌物（淋菌性尿道炎的表现），结合患者病史、临床表现和体查，此时淋病（D对）可能性大。梅毒（八版病理学P351）（A错）早期主要表现为硬性下疳，随后出现梅毒疹，严重的三期梅毒可累及心脏和中枢神经系统，形成特征性的树胶样肿。生殖器疱疹（八版皮肤性病学P232）（B错）主要表现为在生殖器或会阴部位聚集或散在的小水泡。常见的疱疹（C错）有水痘、带状疱疹、单纯疱疹、生殖器疱疹等疾病。艾滋病（E错）由感染艾滋病病毒（HIV病毒）引起，HIV感染者要经过数年、甚至长达10年或更长的潜伏期后才会发展成艾滋病病人，故可能性不大。